随雌激素浓度不断增多，至排卵期变得稀薄、透明，拉丝度达
A. 6cm
B. 8cm
C. 10cm
D. 12cm
E. 15cm

正确答案：C。10cm

解析：宫颈黏液周期性变化：在卵巢性激素影响下，宫颈腺细胞分泌黏液，有周期性改变。月经来潮后，体内雌激素浓度降低，宫颈管黏液很少。随雌激素浓度不断增多，宫颈黏液分泌量不断增加，至排卵期变得稀薄、透明，拉丝度达10cm。掌握“女性生殖系统生理”知识点。